对肝癌的临床诊断最具特异性的是
A. 肝区疼痛
B. 进行性肝大，质硬
C. 恶病质
D. 梗阻性黄疸
E. 肺部转移病

正确答案：B。进行性肝大，质硬

解析：肝癌最具特异性的体征是进行性肝大，质硬（B对）。肝区疼痛（A错）可见于肝、胆囊炎、胆结石等多类疾病；恶病质（C错）普遍见于高消耗性疾病如恶性肿瘤等；梗阻性黄疸（D错）见于胆汁流出道梗阻性疾病，如胆总管结石梗阻、肝癌、壶腹部占位性病变等，均不具有特异性。肺部转移病（E错）是晚期肝癌肝外转移最常见的病变。